肾上腺皮质功能亢进会出现
A. 呆小症
B. 巨人症
C. 侏儒症
D. 库欣（Cushing）综合征
E. 艾迪生（Addison）病

正确答案：D。库欣（Cushing）综合征